火热之邪致病可见
A. 皮肤干皲
B. 狂躁妄动
C. 汗出恶风
D. 下利清谷，小便清长
E. 下利黏液，小便浑浊

正确答案：B。狂躁妄动

解析：火热之邪易扰神，火热与心相通应，故火热之邪入于营血，尤易影响心神，轻者心神不宁而心烦、失眠；重者可扰乱心神，出现狂躁不安，或神昏谵语等症（B对）。燥性干涩，易伤津液，燥邪为干涩之病邪，侵犯人体，最易损伤津液，出现各种干燥、涩滞的症状，如口鼻干燥，咽干口渴，皮肤干涩，甚则皲裂毛发不荣，小便短少，大便干结等（A错）。风性开泄，其伤人易室腠理不固而汗出恶风（C错）。寒为阴邪，易伤阳气，感受寒邪，最易损伤人体阳气，若寒邪直中于少阴，损伤心肾阳气，则可见恶寒蜷卧，手足厥冷，下利清谷，小便清长，精神萎靡，脉微细等症（D错）。湿性重浊黏滞趋下，湿邪为患，易出现分泌物和排泄物秽浊不清的特征，如下利黏液，小便浑浊（E错）。